超急性排斥反应中，同种异型抗原特异性抗体通过激活补体作用引起
A. 血管内皮细胞损伤
B. 凝血聚集
C. 移植物细胞裂解
D. 血小板聚集
E. 以上说法均正确

正确答案：E。以上说法均正确

解析：在超急性排斥反应中，同种异型抗原特异性抗体通过激活补体、调理吞噬和ADCC等作用引起血管内皮细胞损伤、凝血、血小板聚集和移植物细胞裂解。掌握“移植免疫”知识点。